下列哪一项不是HLA抗原的功能
A. 诱导移植排斥反应
B. 参与胸腺T淋巴细胞分化发育
C. 参与自身免疫耐受的形成
D. 参与抗原的呈递
E. 参与调理吞噬

正确答案：E。参与调理吞噬